向病人及医护人员提供用药咨询和保健咨询，指导其安全、有效、经济、合理地使用药品是
A. 执业药师的职责
B. 执业药师的权力
C. 执业药师的权利
D. 执业药师的义务
E. 执业药师的执业行为规范

正确答案：A、E。执业药师的职责；执业药师的执业行为规范

解析：本题考查执业药师的职责。向病人及医护人员提供用药咨询和保健咨询，指导其安全、有效、经济、合理地使用药品是执业药师的职责（A对）和行为规范（E对）。《执业药师资格制度暂行规定》（人发[1999]34号）中明确了执业药师具体职责：①执业药师必须遵守职业道德，忠于职守，以对药品质量负责、保证公众用药安全有效为基本准则；②执业药师必须严格执行《药品管理法》及国家有关药品研制、生产、经营、使用的各项法规及政策，对违反《药品管理法》及有关法规的行为或决定，有责任提出劝告、制止、拒绝执行并向上级报告。③执业药师在执业范围内负责对药品质量的监督和管理，参与制定、实施药品全面质量管理及对本单位违反规定的处理；④执业药师负责处方的审核及监督调配，提供用药咨询与信息，指导合理用药，开展治疗药物的监测及药品疗效的评价等临床药学工作。